不属于苯二氮卓类药物作用特点的是
A. 具有抗焦虑作用
B. 具有外周性肌松作用
C. 具有镇静作用
D. 具有催眠作用
E. 用于癫痫持续状态

正确答案：B。具有外周性肌松作用